《中国药典》规定，以人参皂苷Rb₁为质量控制成分的是
A. 芦荟
B. 丹参
C. 党参
D. 秦皮
E. 三七

正确答案：E。三七

解析：本题考查的是中药三七的质量控制成分。《中国药典》规定，以人参皂苷Rb₁为质量控制成分的是三七（E对）。三七中主要化学成分是三萜皂苷类，含量高达12%。《中国药典》以人参皂苷Rg₁、人参皂苷Rb₁及三七皂苷R₁为指标成分进行含量测定，要求三者总量不得少于5.0%。芦荟（A错）中主要活性成分是羟基蒽醌类衍生物，包括芦荟大黄素、大黄酸、大黄素、大黄酚、大黄素甲醚等。《中国药典》以芦荟苷为指标成分进行含量测定，芦荟苷含量不得少于16.0%。丹参（B错）的化学成分主要包括脂溶性成分和水溶性成分两大部分。脂溶性成分大多为共轭醌、酮类化合物。如丹参酮Ⅰ、丹参酮ⅡA、丹参酮ⅡB、隐丹参酮等。《中国药典》采用高效液相色谱法测定丹参中丹参酮类和丹酚酸B的含量，要求丹参酮ⅡA、隐丹参酮和丹参酮Ⅰ的总量不得少于0.25%，丹酚酸B不得少于3.0%。另外，水溶性成分则包括丹参素，丹参酸A、丹酚酸B，原儿茶酸，原儿茶醛等。秦皮（D错）的原植物主要有两种，即木犀科植物大叶白蜡树及白蜡树，大叶白蜡树皮中主要含七叶内酯（秦皮乙素）和七叶苷（秦皮甲素），而白蜡树皮中主要含白蜡素和七叶内酯以及白蜡树苷。《中国药典》采用高效液相色谱法并规定本品按干燥品计，含秦皮甲素、秦皮乙素的总量不得少于1.0%。党参（C错）的质量控制成分，2022年考试指南未明确说明。